治疗上消化道出血脾不统血证，应首选
A. 泻心汤合十灰散加减
B. 龙胆泻肝汤加减
C. 归脾汤加减
D. 独参汤加减
E. 四味回阳饮加减

正确答案：C。归脾汤加减

解析：脾不统血证的机理为脾气亏虚，失于统摄血，故见一系列出血及气血亏虚症状，应予以健脾益气，养血摄血治疗，方药当选用健脾益气，养血统血的归脾汤加减（C对）。泻心汤合十灰散加减（A错）功效为清胃泻火、化瘀止血，多用来治疗胃中积热证；龙胆泻肝汤加减（B错）功效为泻肝清胃、凉血止血，多用来治疗肝火犯胃证；独参汤（D错）或四味回阳饮（E错）的功效为益气摄血，回阳固脱，多用来治疗气随血脱证。